人体试验必须以（）为前提
A. 有利于提高人类健康水平
B. 维护受试者的安康
C. 维护受试者利益
D. 实验者严谨求实
E. 有利于促进医学科学发展

正确答案：B。维护受试者的安康